患儿，6个月，近日脘腹胀满，嗳腐酸馊，时呕吐，哭闹，大便酸臭，手足心热，舌苔白厚腻，指纹紫滞。应选用的方剂是
A. 健脾丸加减
B. 二陈汤加减
C. 消乳丸加减
D. 温胆汤加减
E. 理中汤加减

正确答案：C。消乳丸加减

解析：本题考查的是积滞的辨证论治。患儿，6个月，近日脘腹胀满，嗳腐酸馊，时呕吐，哭闹，大便酸臭，手足心热，舌苔白厚腻，指纹紫滞。应选用的方剂是消乳丸加减（C对）。积滞，是指小儿内伤乳食，停聚中焦，积而不化，气滞不行所致的疾病，以脘腹胀满、嗳气酸腐、不思乳食、食而不化、大便溏薄或秘结酸臭为临床特征。西医学的小儿消化不良表现为上述症状者，可参考此内容辨证论治。（一）乳食内积证：【症状】不思乳食，嗳腐酸馊，或呕吐食物、乳片，脘腹胀满疼痛，大便酸臭或便秘，烦躁啼哭，夜眠不安，手足心热。舌质红，苔白厚，或黄厚腻，脉弦滑，或指纹紫滞。【方剂应用】基础方剂为乳积用消乳丸（香附、神曲、麦芽、陈皮、砂仁、甘草）加减；食积用保和丸（山楂、神曲、半夏、茯苓、陈皮、连翘、莱菔子）加减。（二）脾虚夹积证：【症状】面色萎黄，形体消瘦，神疲肢倦，不思乳食，食则饱胀，腹满喜按，大便溏稀酸腥，夹有乳片或不消化食物残渣。舌质淡，苔白腻，脉细滑，或指纹淡滞。【方剂应用】基础方剂为健脾丸（人参、白术、陈皮、麦芽、山楂、神曲、枳实）加减（A错）。二陈汤加减（B错）为喘证痰浊阻肺证的方剂应用。喘证痰浊阻肺证：【症状】喘而胸满闷塞，甚则胸盈仰息，咳嗽，痰多黏腻色白，咳吐不利，兼有呕恶，食少，口黏不渴。舌苔白腻，脉滑或濡。【方剂应用】基础方剂为二陈汤（陈皮、半夏、茯苓、甘草、生姜、乌梅）合三子养亲汤（紫苏子、白芥子、莱菔子）加减。方剂应用为温胆汤加减（D错）或理中汤加减（E错）的病证，2022年考试指南未明确说明。温胆汤：【功能】理气化痰，和胃利胆。【主治】胆郁痰扰证。胆怯易惊，头眩心悸，心烦不眠，夜多异梦；或呕恶呃逆，眩晕，癫痫。苔白腻，脉弦滑。临床常用于治疗神经官能症、急慢性胃炎、消化性溃疡、慢性支气管炎、梅尼埃病、更年期综合征、癫痫等属胆郁痰扰者。理中汤：【功能】温中祛寒，补气健脾。【主治】脾胃虚寒证，症见腹痛、池泻清稀、呕吐、不渴、或腹满食少、舌淡苔白、脉沉细或迟缓。